治疗月经先后不定期肝郁肾虚证，应首选
A. 丹皮、黄柏、熟地、白芍、茯苓、青蒿、地骨皮
B. 丹皮、黄柏、熟地、白芍、茯苓、阿胶、麦门冬
C. 丹皮、黄柏、熟地、白芍、山药、太子参、麦门冬
D. 当归、白芍、熟地、黑荆芥、柴胡、山药、茯苓、菟丝子
E. 当归、赤芍、熟地、黑荆芥、柴胡、茯苓、续断、女贞子

正确答案：D。当归、白芍、熟地、黑荆芥、柴胡、山药、茯苓、菟丝子

解析：月经先后不定期的肝郁肾虚证主要是肝肾功能失常，冲任失调，血海蓄溢无常。治宜疏肝补肾，养血调经，方用定经汤《傅青主女科》 ，其中定经汤的组成为：菟丝子、白芍、当归、熟地、山药、茯苓、黑荆芥穗、柴胡（D对）。